下列药物中，需要查光学异构体的是
A. 异烟肼
B. 硝苯地平
C. 左氧氟沙星
D. 盐酸氯丙嗪
E. 氟康唑

正确答案：C。左氧氟沙星

解析：本题考查手性药物。氧氟沙星是一种手性药物，存在左旋的氧氟沙星和右旋的氧氟沙星（C对）。